唾液腺黏液囊肿最常见的好发部位是
A. 上唇
B. 下唇
C. 腮腺
D. 舌下腺
E. 颌下腺

正确答案：B。下唇

解析：黏液囊肿是最常见的小唾液腺瘤样病变，好发于下唇及舌尖腹侧，这是因为舌体运动常受下前牙摩擦以及自觉或不自觉地咬下唇动作使黏膜下腺体受伤。掌握“舌下腺及唾液腺黏液囊肿”知识点。